男性，35岁，劳力性呼吸困难，心悸，气短，少尿，下肢浮肿1年余，1周前咽痛、咳嗽、咯黄痰后呼吸困难加重，夜间不能平卧。超声心动图示，左右心室扩张，弥漫性运动不良，左心室射血分数30%。口服地高辛0.25mg，1次/d，既往无任何特殊病史。引起上述考虑的原因是
A. 高血压心脏病
B. 心肌梗死
C. 扩张型心肌病
D. 心肌炎
E. 甲亢性心脏病

正确答案：C。扩张型心肌病

解析：患者表现为全心衰，慢性心衰的症状持续一个月，既往无特殊病史，超声心动显示左右心室扩张、弥漫性运动不良，支持扩张性心肌病的诊断。心肌炎也可以出现心室扩张、运动不良，但是一般病史比较短，多于感染后四周左右发病。患者既往无高血压及冠心病的病史（二者以左心受累常见），没有心慌、手抖、消瘦等甲亢的临床表现，故以上三个诊断可以排除。掌握“心力衰竭”知识点。